小儿符合中度等渗性脱水的是
A. 失水量占体重的6%，血清钠155mmol/L
B. 失水量占体重的3%，血清钠135mmol/L
C. 失水量占体重的7%，血清钠120mmol/L
D. 失水量占体重的8%，血清钠140mmol/L
E. 失水量占体重的11%，血清钠140mmol/L

正确答案：D。失水量占体重的8%，血清钠140mmol/L

解析：小儿轻、中、重度脱水失水量约占体重的3%～5%、5%～10%、＞10%（BE错）。小儿血钠正常值为130～150mmol/L，血钠＜130mmol/L为低渗性脱水，血钠130～150mmol/L为等渗性脱水，血钠＞150mmol/L为高渗性脱水（D对AC错）。A为中度高渗性脱水，B为轻度等渗性脱水，C为中度低渗性脱水，E为重度等渗性脱水。